男，70岁。间断咳嗽30余年，加重伴意识障碍2天入院。查体：T38.0℃，P102次/分，R21次/分，BP120/80mmHg，烦躁不安，球结膜充血水肿，口唇发绀。桶状胸，双肺可闻及哮鸣音，双下肺少量湿性啰音。该患者禁忌使用的药物是
A. 甲泼尼龙
B. 地西泮
C. 氨茶碱
D. 地塞米松
E. 头孢曲松

正确答案：B。地西泮

解析：患者为中老年男性，间断咳嗽30余年，可见桶状胸（为慢阻肺的典型体征），提示有慢性阻塞性肺疾病，加重后伴有意识障碍，发热，烦躁，结膜充血水肿，发绀，双肺可闻及哮鸣音以及少量湿性啰音，说明该患者现为慢阻肺急性加重期。急性加重期最多见的原因就是细菌或者病毒感染，应用抗生素（E对）可治疗或预防感染。糖皮质激素可缓解症状，因此甲泼尼龙（A对）与地塞米松（D对）对治疗有效。氨茶碱（C对）可舒张支气管，对于慢阻肺的治疗均有效果。地西泮（B错，为本题正确答案）为镇静药物，该患者已经发生意识障碍，发生了肺性脑病，镇静药物明显不适于该患者的治疗。